雷公藤的使用注意有
A. 内服宜慎
B. 孕妇忌服
C. 白细胞减少症者慎用
D. 外敷不可超过半小时
E. 心、肝、肾器质性病变者慎服

正确答案：A、B、C、D、E。内服宜慎；孕妇忌服；白细胞减少症者慎用；外敷不可超过半小时；心、肝、肾器质性病变者慎服

解析：本题考查的是雷公藤的使用注意。雷公藤的使用注意有内服宜慎（A对）、孕妇忌服（B对）、白细胞减少症者慎用（C对）外敷不可超过半小时（D对）与心、肝、肾器质性病变者慎服（E对）。雷公藤：【使用注意】本品毒剧，故内服宜慎，孕妇忌服，患有心、肝、肾器质性病变或白细胞减少症者慎服。外敷不可超过半小时，否则起疱。带皮者毒剧，用时宜去皮。